气滞胃痛颗粒的功效
A. 疏肝理气，和胃止痛
B. 理气解郁，宽中除满
C. 健脾和胃，行气化湿
D. 消炎止痛，理气健胃
E. 柔肝理气，制酸止痛

正确答案：A。疏肝理气，和胃止痛

解析：本题考查气滞胃痛颗粒的功能。气滞胃痛颗粒的功效疏肝理气，和胃止痛（A对）。气滞胃痛颗粒（片）【功能】疏肝理气，和胃止痛。越鞠丸【功能】理气解郁，宽中除满（B错）。木香顺气丸（颗粒）【功能】行气化湿，健脾和胃（C错）。